根据《药品流通监督管理办法》，有关医疗机构购进、储存药品的叙述，错误的是
A. 医疗机构购进药品，必须建立真实完整的药品购进记录，并直接入库
B. 医疗机构储存药品，首先应当制订和执行有关药品保管、养护的制度
C. 医疗机构对化学药品和中成药应分别储存、分类存放
D. 医疗机构不得未经诊疗直接向患者提供药品
E. 医疗机构不得采用邮售的方式直接向公众销售处方药

正确答案：A。医疗机构购进药品，必须建立真实完整的药品购进记录，并直接入库

解析：本题考查医疗机构采购药品质量管理和进货检查验收制度。公立医疗机构在药品验收入库时，必须验明票、货、账三者一致方可入库、使用（A错，为本题正确答案）。《医疗机构药品监督管理办法（试行）》第二章药品购进和储存第九条：医疗机构必须建立和执行进货验收制度，购进药品应当逐批验收，并建立真实、完整的药品验收记录。医疗机构接受捐赠药品、从其他医疗机构调入急救药品也应当遵守前款规定。第十三条：医疗机构储存药品，应当按照药品属性和类别分库、分区、分跺存放，并实行色标管理。药品与非药品分开存放；中药饮片、中成药、化学药品分别储存、分类存放（C对）；过期、变质、被污染等药品应当放置在不合格库（区）。第十四条：医疗机构应当制定和执行药品保管、养护管理制度（B对），并采取必要的控温、防潮、避光、通风、防火、防虫、防鼠、防污染等措施，保证药品质量。第三章药品调配和使用第二十三条：医疗机构不得采用邮售、互联网交易、柜台开架自选等方式直接向公众销售处方药（E对）。